金黄色葡萄球菌肠毒素是
A. TI-Ag
B. 超抗原
C. 自身抗原
D. 同种异型抗原
E. 半抗原

正确答案：B。超抗原